不引起肺组织坏死和空洞形成的肺炎致病菌是
A. 肺炎链球菌
B. 葡萄球菌
C. 铜绿假单胞（绿脓）菌
D. 克雷伯杆菌
E. 肺炎支原体

正确答案：A。肺炎链球菌

解析：SP（肺炎链球菌）不产生毒素，其致病力是由荚膜对组织的侵袭作用，引起肺泡壁水肿和渗出，不引起组织坏死或形成空洞（A对）。葡萄球菌（B错）、铜绿假单胞菌（C错）、克雷伯杆菌（D错）均属于化脓性细菌，可引起肺组织坏死、破坏，都可累及肺实质，引起肺组织坏死和空洞形成。支原体肺炎（E错）主要累及肺间质，呈典型间质性肺炎的病理改变，也可累及肺实质，呈支气管肺炎的改变，引起肺组织坏死和空洞形成，但是较少见。